可以由省级药品监督管理部门制定的药品标准是
A. 中国药典
B. 企业标准
C. 药品注册标准
D. 行业标准
E. 炮制规范

正确答案：E。炮制规范

解析：本题考查的是国家药品标准的定义。可以由省级药品监督管理部门制定的药品标准是炮制规范（E对）。国家药品标准的定义：国家药品标准是国家对药品质量要求和检验方法所做的技术规定，是药品生产、供应、使用、检验和管理共同遵循的法定依据。《药品管理法》规定，药品应当符合国家药品标准。经国务院药品监督管理部门核准的药品质量标准高于国家药品标准的，按照经核准的药品质量标准执行；没有国家药品标准的，应当符合经核准的药品质量标准。国务院药品监督管理部门颁布的《中华人民共和国药典》（A错）和药品标准为国家药品标准。《药品管理法》还规定，中药饮片必须按照国家药品标准炮制；国家药品标准没有规定的，必须按照省级药品监督管理部门制定的炮制规范炮制。省级药品监督管理部门制定的炮制规范应当报国家药品监督管理部门备案。”。药品注册标准（C错）：药品注册标准是指国家药品监督管理部门核准给申请人特定药品的质量标准。药品应当符合国家药品标准和经国家药品监督管理局核准的药品质量标准。药品注册标准应当符合《中国药典》通用的技术要求，不得低于《中国药典》的规定。申报品种的检测项目或者指标不适用《中国药典》的，申请人应当提供充分的支持性数据。法定标准是包括中国药典在内的国家药品标准和经国务院药品监督管理部门核准的药品质量标准；非法定标准有行业标准（D错）、团体标准、企业标准（B错）等。法定标准属于强制性标准，是药品质量的最低标准，拟上市销售的任何药品都必须达到这个标准；企业标准只能作为企业的内控标准，各项指标均不得低于国家药品标准。